根据《处方管理办法》，医疗机构中可以调剂麻醉药品和第一类精神药品的人员必须是
A. 经本医疗机构培训，取得临床药师资格的人员
B. 经本单位技术评定具有药士以上资格的专业技术人员
C. 经省级药品监督管理部门考核合格后取得调剂资格的药师
D. 经卫生行政部门考试合格并取得麻醉药品和第一类精神药品调剂资格的药师
E. 经本医疗机构培训，考核合格并取得麻醉药品和第一类精神药品调剂资格的药师

正确答案：E。经本医疗机构培训，考核合格并取得麻醉药品和第一类精神药品调剂资格的药师

解析：本题考查的是处方权的获得。根据《处方管理办法》，医疗机构中可以调剂麻醉药品和第一类精神药品的人员必须是经本医疗机构培训，考核合格并取得麻醉药品和第一类精神药品调剂资格的药师（E对）。处方权的获得：经注册的执业医师在执业地点取得相应的处方权。经注册的执业助理医师在乡、民族乡、镇、村的医疗机构独立从事一般的执业活动，可以在注册的执业地点取得相应的处方权。经注册的执业助理医师在医疗机构开具的处方，应当经所在执业地点执业医师签名或加盖专用签章后方有效。试用期人员开具处方，应当经所在医疗机构有处方权的执业医师审核并签名或加盖专用签章后方有效。医师应当在注册的医疗机构签名留样或者专用签章备案后，方可开具处方。医疗机构应当对本医疗机构执业医师和药师进行麻醉药品和精神药品使用知识和规范化管理的培训。执业医师经考核合格后取得麻醉药品和第一类精神药品的处方权，药师经考核合格后取得麻醉药品和第一类精神药品调剂资格。医师取得麻醉药品和第一类精神药品处方权后，方可在本医疗机构开具麻醉药品和第一类精神药品处方，但不得为自己开具该类药品处方。药师取得麻醉药品和第一类精神药品调剂资格后，方可在本医疗机构调剂麻醉药品和第一类精神药品。